女，20岁。一周前出现发热、鼻塞伴乏力，体温38°C左右，轻度咳嗽，无咳痰，3天前感活动时憋气、心悸，症状逐渐加重，既往体健。查体：T37.2°C，BP90/70mmHg，双肺可闻及湿啰音，心脏轻度向左扩大，心率120次/分，律齐，S1减弱，可闻及奔马律。血cTnI（+）。最可能的诊断是
A. 急性心肌梗死
B. 急性心包炎
C. 肺炎
D. 病毒性心肌炎
E. 扩张型心肌病

正确答案：D。病毒性心肌炎

解析：年轻女性，一周前出现发热、鼻塞伴乏力，体温38°C左右（病毒感染前驱症状），3天前感活动时憋气、心悸，症状逐渐加重（病毒性心肌炎的症状）。查体：T37.2°C，BP90/70mmHg（低血压休克），双肺可闻及湿啰音，心脏轻度向左扩大，心率120次/分（心率快且与体温不相称），律齐，S1减弱，可闻及奔马律（病毒性心肌炎的体征）。血cTnI（+）（病毒性心肌炎可有肌钙蛋白（T或I）增高）。根据病人典型的前驱感染史、症状、体征、心肌酶学检查，考虑诊断为病毒性心肌炎（D对）。急性心肌梗死（A错）多发病于中老年男性患者（60岁以上男女发病一致），患者多有高血压、动脉粥样硬化等基础疾病，临床表现以诱因不明显，程度重、时间长、难以缓解的心前区压榨性疼痛为典型特点，可有发热、心律失常、低血压、休克及心衰等相应表现。查心电图呈动态特征性改变可资鉴别（P234）。急性心包炎（B错）前期为纤维蛋白渗出期，临床表现有与呼吸相关的胸骨后、心前区疼痛，可伴放射痛，心包摩擦音为最具诊断价值的体征；后期心包积液明显，表现为呼吸困难、水肿，听诊心音低弱而遥远。查心电图可见 ST段呈弓背向下型抬高（P302）。扩张性心肌病（E错） 是一类以左心室或双心室扩大伴收缩功能障碍为特征的心肌病。查超声心动图示心室腔扩大，左室腔为主，室壁运动减弱，心肌收缩能力下降有助于明确诊断（P261）。